某心衰患者伴有心绞痛、高血脂和支气管哮喘，可选用的药物是
A. 卡托普利
B. 卡维地洛
C. 氢氯噻嗪
D. 氯沙坦
E. 多巴酚丁胺

正确答案：E。多巴酚丁胺

解析：本题考查多巴酚丁胺。多巴酚丁胺（E对）主要激动心脏β₁受体，可用于伴有心绞痛的心衰患者，且无呼吸系统不良反应。卡托普利（A错）与氯沙坦（D错）易引起干咳；卡维地洛（B错）容易引起高脂血症及哮喘；氢氯噻嗪（C错）可能引起高血脂。